某市卫生行政部门计划对该市65周岁以上老年人进行口腔健康状况调查，并依据调查结果制定今后的口腔疾病控制规划。进行标准一致性检验后，某检查者的Kappa值为0.61，说明可靠度为
A. 不可靠
B. 不合格
C. 中等
D. 优
E. 完全可靠

正确答案：D。优

解析：本题考查标准一致性试验。某市卫生行政部门计划对该市65周岁以上老年人进行口腔健康状况调查，并依据调查结果制定今后的口腔疾病控制规划。进行标准一致性检验后，某检查者的Kappa值为0.61，说明可靠度为优（D对）。标准一致性试验就是可靠度的检验。Fleiss规定Kappa值的大小与可靠度的关系为：0.40以下：可靠度不合格（B错）；0.41～0.60：可靠度中等（C错）；0.61～0.80：可靠度优；0.81～1.00：完全可靠（E错）。